在妊娠期间子宫肌瘤容易发生的变性是
A. 玻璃样变
B. 囊性变
C. 红色变
D. 肉瘤变
E. 钙化

正确答案：C。红色变

解析：妊娠期间容易发生的是红色变（C对）。玻璃样变（P311）（A错）是最常见的变性，继续发展可变成囊样变（P311）（B错）。肉瘤样变（P311）（D错）多见于绝经后伴疼痛或出血者。钙化（P311）（E错）多见于蒂部细小、血供不足的浆膜下肌瘤以及绝经后的妇女。